蛋白质-能量营养不良最为常见的并发症是
A. 自发性低血糖
B. 营养性贫血
C. 感染
D. 佝偻病
E. 微量元素缺乏

正确答案：B。营养性贫血

解析：蛋白质-能量营养不良最为常见的并发症是营养性贫血，由于营养不良常伴有铁、叶酸、维生素B12等营养物质缺乏而导致贫血，最常见者为营养性缺铁性贫血（B对D错）。迁延不愈的营养不良患儿可突然发生低血糖。若不及时诊治，可危及生命，不是最常见的并发症（A错）。由于免疫力低下，易患各种感染，感染又可加重营养不良，形成恶性循环，不是最常见的并发症（C错）。尤以维生素A缺乏最为常见，还可伴有维生素B、C的缺乏。由于生长迟缓，钙、磷需要较少，因而继发严重的维生素D缺乏较为少见（E错）。